皮样囊肿与表皮样囊肿的主要区别是
A. 皮样囊肿的囊壁不含皮肤附属结构
B. 表皮样囊肿的囊壁含皮肤附属结构
C. 皮样囊肿含一种或多种皮肤附属结构
D. 皮样囊肿内不含角化物
E. 表皮样囊肿内不含角化物

正确答案：C。皮样囊肿含一种或多种皮肤附属结构

解析：本题考查皮样囊肿与表皮样囊肿的区别。皮样囊肿与表皮样囊肿的主要区别是皮样囊肿含一种或多种皮肤附属结构（C对）。皮样囊肿与表皮样囊肿的主要区别是皮样囊肿囊壁含一种或多种皮肤附属结构（C对A错），如皮脂腺、汗腺和毛发等；表皮样囊肿囊壁中无皮肤附属结构（B错）。二者囊壁中均含有皮肤，上皮细胞脱落后可有角化物（DE错），这是共同点。